休克初期造成微循环缺血的主要机制是：
A. 抗利尿激素的作用
B. 血栓素A2的作用
C. 交感-肾上腺髓质系统兴奋
D. 肾素-血管紧张素系统兴奋
E. 内皮素的作用

正确答案：C。交感-肾上腺髓质系统兴奋

解析：有效循环血益减少使微循环血液灌流减少，以及交感－肾上腺髓质系统强烈兴奋（C对）和缩血管物质增多进一步加重微循环的缺血缺氧是休克初期造成微循环缺血的主要机制。抗利尿激素（A错）、血栓素A2（B错）、肾素-血管紧张素（D错）和内皮素（E错）休克初期其他缩血管体液因子释放（P172），不是主要机制。